合欢皮是临床常用的安神药，其除能解郁安神外，还能
A. 祛痰开窍
B. 祛风通络
C. 清热解毒
D. 活血消肿
E. 利尿通淋

正确答案：D。活血消肿

解析：本题考查的是合欢皮的功能。合欢皮除能解郁安神外，还能活血消肿（D对）。合欢皮：【功效】解郁安神，活血消肿。远志：【功效】安神益智，祛痰开窍（A错），消散痈肿。夜交藤：【功效】养心安神，祛风通络（B错）。朱砂：【功效】镇心安神，清热解毒（C错）。琥珀：【功效】安神定惊，活血散瘀，利尿通淋（E错）。